女性，27岁。诉全口牙龈肿胀、出血不止、疼痛明显3天。口腔检查：全口牙龈肿大波及牙间乳头、边缘龈和附着龈，颜色苍白，龈缘处有坏死溃疡，局部有渗血。口腔黏膜上可见出血点，为了进一步明确诊断还应做的辅助检查是
A. 探诊牙周袋
B. 叩诊
C. X线片检查
D. 及时做血常规检验
E. 进行细菌学检查

正确答案：D。及时做血常规检验

解析：本题考查白血病的牙龈病损的诊断。通过患者主诉及口腔检查可初步推断患者的牙龈表现符合白血病的牙龈病损特点，白血病的牙龈病损可波及牙龈乳头、龈缘和附着龈，其主要表现是：①牙龈肿大，颜色苍白，牙龈肿胀常为全口性，牙龈一般有明显的炎症；②龈缘处组织坏死、溃疡和假膜形成，有口臭；③牙龈有明显的出血倾向，龈缘常有渗血，且不易止住，牙龈和口腔黏膜上可见出血点或瘀斑；④严重的患者可出现口腔黏膜的坏死或剧烈的牙痛、发热、局部淋巴结肿大、贫血等症状。白血病是一种恶性血液疾病，血液中不成熟血细胞的数量和形态异常，为进一步明确诊断需及时作血涂片检查及血常规检验（D对），发现血细胞数目及形态的异常，便可作出初步诊断。探诊牙周袋（A错）主要是为了解牙周支持组织的丧失状况，探测整个牙列的牙周袋深度、牙周附着水平、牙周袋有无出血等，该患者无牙周袋，故无需进行牙周袋探诊。叩诊（B错）是指根据患者的反应和叩击声音来确定患牙的方法，也可根据叩诊方向来确定患牙炎症是来自于根尖部还是根周部，该患者病损发生于牙龈及口腔黏膜，无牙体牙髓组织疾病，故叩诊对于明确疾病的诊断无意义。X线片检查（C错）可用来检查难以发现的龋齿、各种根尖周病、颌骨囊肿以及牙槽骨吸收破坏等疾病，不能反映牙周软组织的病变。进行细菌学检查（E错）可以判断细菌的种类，便于进行更有针对性的治疗，但该患者并未出现特异性细菌感染症状，故无需进行细菌学检查。